不是WHO推荐的“最划算”的干预措施的是
A. 禁止烟草广告、促销和赞助
B. 减少加工食品中的食盐添加
C. 全面禁止使用反式脂肪
D. 接种乙肝疫苗
E. 在社区脑卒中高危人群中开展颈动脉超声筛查

正确答案：E。在社区脑卒中高危人群中开展颈动脉超声筛查

解析：本题考查WHO推荐的“最划算”的干预措施。根据表12-3可知，禁止烟草广告、促销和赞助（A对）；减少加工食品中的食盐添加（B对）；全面禁止使用反式脂肪（C对）；接种乙肝疫苗（D对）均属于WHO推荐的“最划算”的干预措施。在社区脑卒中高危人群中开展颈动脉超声筛查（E错，为本题正确答案）不是WHO推荐的“最划算”的干预措施。